治疗痛经湿热下注证，应首选
A. 清热调血汤
B. 龙胆泻肝汤
C. 知柏地黄汤
D. 血府逐瘀汤
E. 加味逍遥散

正确答案：A。清热调血汤

解析：痛经 湿热瘀阻证治疗宜清热除湿，化瘀止痛，清热调血汤的功效为清热除湿，活血止痛，为治疗痛经湿热瘀阻证的首选（A对）。龙胆泻肝丸的功效为清泻肝胆实火，清利肝经湿热，治疗肝胆实火上炎证及肝经湿热下注证（B错）。知柏地黄丸的功效为滋阴降火，用以治疗肝肾阴虚，虚火上炎证（C错）。血府逐瘀汤的功效为活血化瘀，行气止痛，用以治疗气滞血瘀之症（D错）。加味逍遥散的功效为养血健脾，疏肝清热，用以治疗肝郁血虚，内有郁热证（E错）。